高锰酸钾与甘油混合研磨时，易发生
A. 变色
B. 沉淀
C. 产气
D. 结块
E. 爆炸

正确答案：E。爆炸

解析：本题考查药物的配伍变化。高锰酸钾与甘油混合研磨时，易发生爆炸（E对）。发生爆炸大多由强氧化剂与强还原剂配伍而引起，如氯化钾与硫，高锰酸钾与甘油，强氧化剂与蔗糖或葡萄糖等。pH改变产生沉淀；由难溶性碱或酸制成的可溶盐。它们因pH的改变而产生沉淀，如水杨酸钠或苯巴比妥钠水溶液因水解遇酸或酸性药物后，会析出水杨酸或巴比妥酸。生物碱可溶性盐遇碱或碱性药物后会析出难溶性（B错）。含酚羟基的药物与铁盐相遇颜色变深（A错）。溴化铵和利尿药配伍，产生氨气（C错）。